军团菌传播、感染的重要载体是
A. 空气
B. 水
C. 食物
D. 气溶胶
E. 细菌

正确答案：D。气溶胶

解析：本题考查军团菌传播、感染的重要载体。气溶胶（D对ABCE错）是军团菌传播、感染的重要载体。冷却塔和空调系统的风机、水龙头、淋浴、加湿器、人工喷泉等是形成气溶胶的主要动因。由于使用集中空调的环境相对密闭，空气流通不畅，场所中新风量不足，以及集中空调冷却系统的设计特点，在循环水被冷却的过程中会产生大量水气，形成气溶胶外排。冷却塔的底部水池容易被外界污染，灰尘和淤泥沉积会形成局部的有利于军团菌生长繁殖的微环境。当军团菌达到一定浓度的时候，会随着气溶胶排向大气，又会被新风口的新风重新送入建筑物中，从而引起传播和感染。